应激时CRH分泌增多最主要的功能是
A. 调控应激时的情绪行为反应
B. 刺激ACTH的分泌进而增加GC的分泌
C. 促进内啡肽释放
D. 促进蓝斑-去甲肾上腺素能神经元的活性
E. 升高血糖

正确答案：B。刺激ACTH的分泌进而增加GC的分泌

解析：刺激ACTH的分泌进而增加GC的分泌（B对）是应激时CRH分泌增多最主要的功能。